具有清心安神功效的藏药方剂是
A. 洁白丸
B. 仁青常觉
C. 志嘎汗散
D. 八味沉香散
E. 七十味珍珠丸

正确答案：D。八味沉香散

解析：本题考查的是八味沉香散的功能。具有清心安神功效的藏药方剂是八味沉香散（D对）。八味沉香散的功能与主治：清心热，养心，安神，开窍。用于热病攻心，神昏谵语；冠心病，心绞痛。洁白丸（A错）的功能与主治：健脾和胃，止痛止吐，分清泌浊。用于胸腹胀满，胃脘疼痛，消化不良，呕吐泄泻，小便不利。仁青常觉（B错）的功能与主治：清热解毒，调和滋补。用于“隆、赤巴、培根”各病，陈旧性胃肠炎、溃疡，“木布”病，萎缩性胃炎，各种中毒症；梅毒，麻风，陈旧热病，炭疽，疖痛，干黄水，化脓等。志嘎汗散（C错）的功能与主治：清热解毒，消炎。用于小儿流感、脑炎等。七十味珍珠丸（E错）的功能与主治：安神，镇静，通经活络，调和气血，醒脑开窍。用于“黑白脉病”“龙血”不调；中风、瘫痪、半身不遂、癫痫、脑溢血、脑震荡、心脏病、高血压及神经性障碍。